关于注射用水的收集和保存的说法，错误的是
A. 采用带有无菌过滤装置的密闭收集系统收集
B. 注射用水可以在80℃以上保温存放
C. 注射用水可以在70℃以上保温循环存放
D. 注射用水可以在4℃以下存放
E. 注射用水制备后24小时以内使用

正确答案：E。注射用水制备后24小时以内使用

解析：本题考查注射用水的收集和保存。关于注射用水的收集和保存的说法，错误的是注射用水制备后24小时以内使用（E错，为本题正确答案）。注射用水一般需新鲜制备，贮存时间一般不得超过12小时，灭菌后贮放不宜超过24小时。注射用水的收集应采用带有无菌过滤装置的密闭收集系统（A对）。注射用水的贮存可采用80℃以上保温（B对）、70℃以上保温循环（C对）或4℃以下无菌状态存放（D对）。